塞因塞用适用于
A. 气滞便秘
B. 气虚便秘
C. 虫积便秘
D. 食积便秘
E. 热结便秘

正确答案：B。气虚便秘

解析：本题考查的是反治。塞因塞用适用于气虚便秘（B对）。塞因塞用：塞因塞用又称“以补开塞”，是指针对闭塞不通的临床表现，用补虚药物进行治疗。适用于因虚而出现闭塞不通假象的真虚假实证。如脾虚腹胀、血虚经闭等。气滞便秘（A错）、虫积便秘（C错）、食积便秘（D错）与热结便秘（E错）均为实证，故不宜采用塞因塞用治法。寒凝、热结、气滞、血瘀、食滞、虫积等，多为实证；至于气虚、血虚、虚寒等，概数虚证。